传统流行病学的内容包括
A. 传染性疾病
B. 非传染性疾病
C. 两者均是
D. 两者均否

正确答案：A。传染性疾病

解析：本题考查传统流行病学的内容。传统流行病学主要是研究传染病（A对BCD错），目前已扩大到全面的疾病和健康状态，包括了疾病、伤害和健康三个层次。